不属于肝门的结构是
A. 肝门静脉
B. 肝固有动脉
C. 肝静脉
D. 肝管
E. 无

正确答案：C。肝静脉

解析：肝门为肝脏面正中一横沟，其内有肝门静脉(A错)左、右支，肝固有动脉(B错)左、右支，肝左、右管(D错)，而肝静脉(C对)属于第2肝门，不属于肝门。